不属于牙周手术的有
A. 根面平整术
B. 根尖切除术
C. 翻瓣术
D. 袋壁刮治术
E. 牙龈切除术

正确答案：B。根尖切除术

解析：本题考查牙周手术。根尖切除术（B错，为本题的正确答案）是治疗根尖囊肿等口腔疾病的治疗措施，不属于牙周手术。牙周病的手术治疗是牙周病总体治疗计划的第二阶段，是牙周治疗的重要组成部分。包括切除性手术、重建性手术、再生性手术、成形及美学手术。切除性手术包括牙龈切除术（E对）、截根术等，目的在于切除感染组织，消灭牙周袋。重建性手术，包括根面平整术（A对）、袋壁刮治术（D对）、翻瓣术（C对）等，目的在于彻底刮除根面及牙周袋袋壁的肉芽组织、根面牙石，使牙周袋变浅，促进骨修复。